患者，男，53岁。慢性肺源性心脏病史，咳嗽痰多，色白黏腻，气短喘息，脘痞纳少，倦怠乏力，舌质淡，苔薄腻，脉滑。其中医治法是
A. 清肺化痰，降逆平喘
B. 涤痰开窍，熄风止痉
C. 温肾健脾，化饮利水
D. 补肺纳肾，降气平喘
E. 健脾益肺，化痰降气

正确答案：E。健脾益肺，化痰降气

解析：“脾为生痰之源，肺为储痰之器”，脾虚生痰，上渍于肺，肺气上逆故咳嗽痰多，色白黏腻，气短喘息；脾运不健故脘痞纳少；脾气虚弱故倦怠乏力；舌质淡，苔薄腻，脉滑，均为痰浊壅肺证的表现，治法为健脾益肺，化痰降气（E对）。清肺化痰，降逆平喘（A错）用于治疗痰热郁肺证。涤痰开窍，熄风止痉（B错）用于治疗痰蒙神窍证。温肾健脾，化饮利水（C错）用于治疗阳虚水泛证。补肺纳肾，降气平喘（D错）用于治疗肺肾气虚证。